男孩，3岁，出生时正常，母乳喂养，5个月后智能渐落后，头发变黄，肤色变白，有时发生抽搐，肌张力较高。为协助诊断应选择的检查是
A. 血钙、磷测定
B. 染色体核型分析
C. 血T₃、T₄、TSH测定
D. 脑电图检查
E. 尿三氯化铁试验

正确答案：E。尿三氯化铁试验

解析：男孩，3岁，出生时正常，母乳喂养，5个月后智能渐落后，头发变黄，肤色变白，有时发生抽搐，肌张力较高等表现临床诊断首先考虑苯丙酮尿症，而尿三氯化铁试验（E对）是一项用于检查尿液是否正常的辅助检查，若病人尿液与三氯化铁呈阳性反应，即紫黑色，提示苯丙氨酸异常，可作为苯丙酮尿症的辅助诊断。而血钙磷测定（A错）常用于维生素D缺乏性佝偻病的辅助诊断，染色体核型分析（B错）常用于遗传性疾病的辅助诊断，血T3、T4、TSH测定（C错）常用于甲状腺相关疾病的辅助诊断，脑电图检查（D错）常用于癫痫等大脑疾病的辅助诊断。